必须打开腹膜腔才能手术的脏器为
A. 膀胱
B. 输尿管
C. 肾
D. 直肠中段
E. 脾

正确答案：E。脾

解析：膀胱(A错)、直肠上段(D错)为腹膜间位器官，肾(C错)、输尿管(B错)为腹膜外位器官，均有部分未被包裹，不一定需要打开腹膜腔才能手术，而脾(E对)为腹膜内位器官，几乎完全被覆盖，必须打开腹膜腔才可进行手术。